医疗卫生机构产生的污水、传染病病人或者疑似传染病病人的排泄物，应如何处理
A. 严格消毒后排入污水处理系统
B. 严格消毒，达到国家规定的排放标准后，排入地表水
C. 严格消毒，达到国家规定的排放标准后，排入污水处理系统
D. 严格消毒后排入地表水
E. 直接排入污水处理系统

正确答案：C。严格消毒，达到国家规定的排放标准后，排入污水处理系统